血肌酐超过265umol/L时慎用的降压药是
A. 美托洛尔
B. 氨氯地平
C. 硝苯地平
D. 阿罗洛尔
E. 依那普利

正确答案：E。依那普利

解析：依那普利属于血管紧张素转换酶抑制剂，当患者血肌酐超过3mg/dL（1mg/dL=88.41umol/L），即265umol/L时，需谨慎使用，应定期监测血肌酐及血钾水平（E对）。美托洛尔（A错）和阿替洛尔（D错）属于β受体拮抗剂（P253），可通过抑制中枢和周围RAAS，抑制心肌收缩力和降低心率发挥降压作用，急性心力衰竭、病态窦房结综合症、房室传导阻滞患者禁用。氨氯地平（B错）和硝苯地平（C错）属于二氢吡啶类钙通道阻滞剂，主要缺点是开始治疗时有反射性交感活性增强，引起心率增快、面部潮红、头痛、下肢水肿等，在重度主动脉瓣狭窄和心室率较快时慎用。